尺泽穴位于
A. 肱二头肌腱桡侧缘
B. 肱二头肌腱尺侧缘
C. 肱二头肌腱桡侧缘的肘横纹中
D. 肱二头肌腱尺侧缘的肘横纹中
E. 肱二头肌腱尺侧缘向外0.5寸处

正确答案：C。肱二头肌腱桡侧缘的肘横纹中

解析：尺泽穴属于手太阴肺经，位于肘横纹上肱二头肌腱桡侧凹陷处（C对）。肱二头肌腱桡侧缘不够详细，不能定位（A错）。肱二头肌腱尺侧缘是一条线，并非穴位（B错）。肱二头肌腱尺侧缘的肘横纹中为曲泽穴（D错）。肱二头肌腱尺侧缘向外0.5寸处无穴（E错）。